肠系膜上动脉
A. 进入乙状结肠系膜根
B. 进入小肠系膜根
C. 是成对的动脉
D. 发出乙状结肠动脉
E. 起自腹腔干

正确答案：B。进入小肠系膜根

解析：肠系膜上动脉越过十二指肠水平部的前面进入小肠系膜根（B对），然后向右髂窝方向走行。